腹部脏器中最容易受损伤的器官是
A. 肝
B. 脾
C. 胰
D. 肾
E. 膀胱

正确答案：B。脾

解析：腹部脏器中最容易受损伤的器官是脾（B对），脾脏损伤约占腹部损伤的40%～50%。肝脏损伤（A错）在腹部损伤中约占20%～30%。在腹部开放性损伤中，常见的受损脏器依次为肝、小肠、胃、结肠、大血管等；在腹部闭合性损伤中，常见的受损脏器依次为脾、肾（D错）、小肠、肝等。胰腺（C错）、膀胱（E错）等由于解剖位置较深，损伤发生率较低。